治疗肺痈，咳吐脓血，胸痛，首选的药物是
A. 川贝母
B. 桔梗
C. 半夏
D. 天南星
E. 旋覆花

正确答案：B。桔梗

解析：桔梗的功效为宣肺，祛痰，利咽，排脓。治疗咳嗽痰多，咯痰不爽，胸闷不畅；咽痛音哑；肺痈吐脓（B对）。川贝母的功效为清热润肺，化痰止咳，散结消痈。治疗肺热燥咳，干咳少痰，阴虚劳嗽，痰中带血；瘰疬，疮毒，乳痈，肺痈（A错）。半夏的功效为燥湿化痰，降逆止呕，消痞散结。治疗湿痰寒痰，咳喘痰多，痰饮眩悸，风痰眩晕，痰厥头痛；胃气上逆，呕吐反胃；胸脘痞闷，梅核气；痈疽肿毒，瘰疬痰核，毒蛇咬伤（C错）。天南星的功效为燥湿化痰，祛风止痉，散结消肿。治疗顽痰咳喘，胸膈胀闷；风痰眩晕，中风痰壅，口眼㖞斜，半身不遂，癫痫，惊风，破伤风；痈肿，瘰疬痰核，蛇虫咬伤（D错）。旋覆花的功效为降气，消痰，行水，止呕。治疗风寒咳嗽，痰饮蓄结，胸膈痞闷，喘咳痰多；呕吐噫气，心下痞硬（E错）。